结核性脑膜炎的脑脊液改变
A. 白细胞数5×10⁶/L，淋巴细胞为主，蛋白0.3g/L，糖3.5mmol/L
B. 白细胞数50×10⁶/L，淋巴细胞为主，蛋白1.0g/L，糖1.5mmol/L
C. 白细胞数2000×10⁶/L，中性粒细胞为主，蛋白1.0g/L，糖3.5mmol/L
D. 白细胞数5×10⁶/L，淋巴细胞为主，蛋白0.8g/L，糖3.5mmol/L
E. 白细胞数5×10⁶/L，淋巴细胞为主，蛋白0.3g/L，糖3.5mmol/L

正确答案：B。白细胞数50×10⁶/L，淋巴细胞为主，蛋白1.0g/L，糖1.5mmol/L

解析：结核性脑膜炎的脑脊液检查对诊断极为重要，白细胞数多为（50～500）×10⁶/L，以淋巴细胞为主，蛋白含量高，一般多为1.0～3.0g/L（B对）。